CD3和CD4分子存在于
A. 所有外周淋巴细胞
B. 所有外周T细胞
C. Th1和Th2
D. Treg和Tc
E. Th1和Tc

正确答案：C。Th1和Th2